语言的发育三个阶段的顺序是
A. 发音、理解、表达
B. 理解、表达、发音
C. 表达、理解、发音
D. 听觉、发音、理解
E. 模仿、表达、理解

正确答案：A。发音、理解、表达

解析：语言的发育必须具备正常的发音器官、听觉和大脑语言中枢，与周围人的交往促进了语言的发育。语言的发育要经过发音、理解、表达三个阶段。掌握“运动和语言发育”知识点。